42岁妇女，患慢性肾炎3年，半年前因早孕行药物流产，现要求避孕指导，本例最恰当的避孕措施应是
A. 安全期避孕
B. 口服短效避孕药
C. 皮下埋植避孕
D. 阴茎套避孕
E. 行输卵管结扎术

正确答案：D。阴茎套避孕

解析：安全期避孕（P381）是根据女性生殖生理的知识推测排卵日期，在判断周期中的易受孕期进行禁欲而达到避孕目的，此法并不十分可靠，因此不宜推广（A错）。慢性肾炎为甾体激素避孕药（短效避孕、皮下埋植避孕）的禁忌证，因此不应选择口服短效避孕（B错）和皮下埋植避孕（C错）。该患者42岁，且半年前行药物流产，说明无生育要求，选择输卵管结扎术（E错）避孕有创。阴茎套避孕（D对）能安全避孕，适用于慢性肾炎3年有避孕要求的患者。